骨上袋
A. 真性牙周袋，袋底位于釉牙骨质界冠方，牙槽骨嵴顶的根方
B. 假性牙周袋，袋底位于釉牙骨质界根方，牙槽骨嵴顶冠方
C. 真性牙周袋，袋底位于釉牙骨质界根方，牙槽骨嵴顶冠方
D. 假性牙周袋，袋底位于牙槽骨嵴顶的根方
E. 真性牙周袋，袋底位于牙槽骨嵴顶的根方

正确答案：C。真性牙周袋，袋底位于釉牙骨质界根方，牙槽骨嵴顶冠方

解析：水平型吸收：是较常见的吸收方式。牙槽间隔、唇颊侧或舌侧的牙槽嵴顶呈水平吸收，而使牙槽嵴顶的高度降低，通常形成骨上袋，即牙周袋底在牙槽嵴顶的冠方。掌握“慢性牙周炎的病因，表现诊断及预后”知识点。